IL-1的主要产生细胞是
A. T细胞
B. 巨噬细胞
C. B细胞
D. NK细胞
E. 中性粒细胞

正确答案：B。巨噬细胞